下列哪项不符合G蛋白的特点
A. 又称为鸟苷三磷酸结合蛋白
B. 由α、β、γ三种亚基组成
C. α亚基能与GTP、GDP结合
D. α亚基具有GTP酶活性
E. βγ结合松驰

正确答案：E。βγ结合松驰

解析：G蛋白又称鸟苷三磷酸结合蛋白（A对），由α、β、γ三种亚基组成，以αβγ三聚体的形式存在于细胞质膜内侧（B对）。α亚基具有多个功能位点，包括与G蛋白偶联受体结合并受其活化调节部位、与βγ亚基相结合的部位、GDP或GTP结合部位（C对）以及与下游效应分子相互作用的部位等，α亚基还具有GTP酶的活性（D对）。βγ紧密结合成二聚体（E错，为本题正确答案），其主要作用是与α亚基形成复合体并定位于质膜内侧。